与链霉素和对氨基水杨酸钠合用可延缓细菌耐药性产生
A. 异烟肼
B. 亚胺培南
C. 沙丁胺醇
D. 阿莫西林
E. 氨苯蝶啶

正确答案：A。异烟肼

解析：本组题考查的是合理用药中联合用药的目的。与链霉素和对氨基水杨酸钠合用可延缓细菌耐药性产生的是异烟肼（A对）。临床上常异烟肼+链霉素+对氨基水杨酸（PAS）或利福平+乙胺丁醇联合应用可延缓结核杆菌的耐药性。阿莫西林（D错）与棒酸（克拉维酸）合用，由于棒酸抑制β-内酰胺酶，提高了亚胺培南（B错）的疗效。急性哮喘时，β₂受体激动药沙丁醇胺（C错）与茶碱合用可得到相加的疗效。氢氯噻嗪与氨苯蝶啶（E错）合用可增强利尿作用，又可防止氢氯噻嗪引起低血钾。